患者，女，46岁。月经紊乱近1年，先后不定期，量少、色红，伴烘热汗出，烦躁易怒，头晕耳鸣，舌红少苔，脉细数。治疗应首选
A. 左归丸
B. 六味地黄丸
C. 左归饮合二至丸
D. 知柏地黄丸
E. 归肾丸

正确答案：C。左归饮合二至丸

解析：患者女，46岁，月经紊乱近一年，先后不定期，绝经前后，肾阴虚冲任失调，则月经提前或先后、多少不定；量少、色红，伴烘热汗出，烦躁易怒，头晕耳鸣，舌红少苔，脉细数，是为肾阴虚之象,可诊断为绝经前后诸证之肾阴虚证，治疗要滋养肾阴，佐以潜阳。左归丸原方治真阴肾水不足，速宜壮水之主以培左肾之元阴而精血自充，没有补益冲任的作用，因此要配合二至丸以补肝肾，益冲任（C对A错）。六味地黄丸功效滋补肝肾，主要治疗肝肾阴虚证（B错）。知柏地黄丸滋阴清热，润燥通淋。用于阴虚津亏证：小便量少淡黄，午后潮热，手足心热，大便干结，颧赤唇红，舌红少苔，脉细滑数（D错）。归肾丸原方治肾水真阴不足，精衰血少，腰酸腿软，形容憔悴，遗泻阳衰等证，可用于治疗肾虚证（E错）。